健康教育中知信行三者之间的关系是
A. 必然关系
B. 因果关系
C. 趋势关系
D. 依存关系
E. 递进关系

正确答案：B。因果关系